有毒金属和有机污染的主要迁移介质是
A. 水
B. 沉积物（颗粒物）
C. 细菌
D. 底泥
E. 生物体

正确答案：B。沉积物（颗粒物）

解析：本题考查污染物的迁移。污染物的迁移是指污染物从某一地点转移到另一地点，从一种介质转移到另 一种介质的过程。有毒金属和有机污染的主要迁移介质是沉积物（颗粒物）（B对ACDE错）。